适用于轻、中度心力衰竭及左、右心室充盈量高的患者的药物是
A. 氢氯噻嗪
B. 米力农
C. 氯沙坦
D. 卡维地洛
E. 多巴酚丁胺

正确答案：A。氢氯噻嗪

解析：本题考查氢氯噻嗪。适用于轻、中度心力衰竭及左、右心室充盈量高的患者的药物是氢氯噻嗪（A对）。氢氯噻嗪为利尿药，可用于轻、中度心力衰竭及左、右心室充盈量高的患者。米力农（B错）为磷酸二酯酶抑制剂类非苷正性肌力药，用于对洋地黄、利尿剂、血管扩张剂治疗无效或欠佳的急、慢性顽固性充血性心力衰竭。氯沙坦（C错）为血管紧张素Ⅱ受体阻断剂，用于轻、中度高血压，适用于不同年龄的高血压患者，对伴有糖尿病、肾病和慢性心功能不全患者有良好疗效。卡维地洛（D错）为α、β受体阻断剂，能够逆转心室重构，改善心肌功能，可用于心功能较稳定的心力衰竭患者的长期治疗。多巴酚丁胺（E错）为β₁受体激动剂，作用于心肌细胞β₁受体，增强心肌收缩力，主要用于与β受体相关的器质性心脏病时心肌收缩力下降引起的急性心力衰竭。